采取哪种印模时必需进行肌功能修整
A. 解剖式印模
B. 牙支持式义齿的印模
C. 黏膜支持式义齿的印模
D. 混合支持式义齿的印模
E. 个别托盘印模

正确答案：C。黏膜支持式义齿的印模

解析：本题考查印模种类。黏膜支持式义齿（C对）的力主要由黏膜和牙槽骨承担，当基托范围小时易引起黏膜组织损伤，适当的基托伸展有利于分散（牙合）力，但应以不妨碍附近组织正常的生理活动为原则，因此在为制作黏膜支持式义齿取印模时，必须做肌功能修整，能够准确记录附近组织的正常形态和活动范围，避免因基托伸展而引起的软组织活动受限，以保证义齿修复取得更好的效果。解剖式印模是在承托义齿的软硬组织处于非功能状态下取得的，为无压力印模，包括牙支持式义齿的印模、黏膜支持式义齿的印模、混合支持式义齿的印模等，而牙支持式义齿（B错）的力主要由基牙承担，故制取印模时一般不用进行肌功能修整；混合支持式义齿（D错）的力由基牙和黏膜共同承担，是否需要肌功能修整要根据具体情况具体判断。因此，解剖式印模（A错）也要根据具体情况进行肌功能修整。个别托盘（E错）常用于全口义齿的印模制取，此时需进行肌功能修整，而用于牙支持式义齿印模等不一定要进行肌功能修整。